谷类主要提供的维生素是
A. 维生素A
B. 维生素D
C. 维生素E
D. 维生素B₁
E. 维生素B₂

正确答案：D。维生素B₁